患者咳嗽。查体：右侧呼吸动度减弱，右下肺叩诊出现浊音，并可闻及支气管呼吸音。应首先考虑的是
A. 右下肺不张
B. 右下肺实变
C. 右侧胸腔积液
D. 右侧气胸
E. 肺气肿

正确答案：B。右下肺实变

解析：右下肺实变的体征为：两侧胸廓对称，患侧呼吸动度可局限性减弱或消失；患侧语音震颤增强；叩诊呈实音；听诊患侧肺泡呼吸音消失，可听到病理学支气管呼吸音（B对）。右下肺不张的体征为，患侧胸廓下陷，呼吸动度减弱或消失；气管偏向患侧，语音震颤减弱或消失；叩诊呈浊音；呼吸音消失，听觉语音减弱或消失（A错）。右侧胸腔积液的体征为患侧胸廓饱满，呼吸动度减弱或消失，语颤消失，叩诊浊音或实音，呼吸音减弱或消失，气管、纵隔、心脏移向健侧（C错）。右侧气胸的体征为胸廓饱满，肋间隙增宽，呼吸动度减弱或消失，叩诊患侧呈鼓音，肝浊音界下移；患侧呼吸音消失或减弱（D错）。肺气肿（E错）一般为胸廓前后径增大，呈桶状胸，呼吸运动减弱，语音震颤减弱，叩诊过清音，心脏浊音界缩小，肝浊音界下移，呼吸音减低。